颞骨组成中不包括
A. 颞鳞
B. 乳突
C. 喙突
D. 岩部
E. 鼓板

正确答案：C。喙突

解析：本题考查蝶骨、颞骨及舌骨的解剖特点。颞骨组成：颞鳞（A对）、乳突（B对）、岩部（D对）和鼓板（E对）。下颌骨下颌支：又称下颌升支，其上端有喙突（C错，为本题正确答案）和髁突（关节突），喙突上有颞肌和咬肌附丽，髁突颈部下方有翼外肌下头附着：两突之间有下颌切迹（乙状切迹）。